患者，女，45岁，31、32、35、36、37、41、42、44、45、46缺失，余牙正常，设计铸造支架修复，34、43设计何种卡环
A. 对半卡环
B. 正型卡环
C. 杆式卡环
D. 环形卡环
E. 应力中断式卡环

正确答案：C。杆式卡环

解析：34、43设计RPI卡环组，卡环为杆式卡环。掌握“局部义齿固位体”知识点。